香附的别名是
A. 栝楼
B. 莎草根
C. 蚤休
D. 仙灵脾
E. 淡大芸

正确答案：B。莎草根

解析：本题考查的是常见饮片的正名与相关别名。香附的别名是莎草根（B对）。香附别名：香附子、莎草根。栝楼（A错）为瓜蒌的别名。瓜蒌别名：全瓜蒌、栝楼、药瓜。蚤休（C错）为重楼的别名。重楼别名：七叶一枝花、蚤休、草河车。仙灵脾（D错）为淫羊藿的别名。淫羊藿别名：仙灵脾。淡大芸（E错）为肉苁蓉的别名。肉苁蓉别名：淡大芸。